癌组织中实质与间质大致相等是
A. 乳腺浸润性导管癌
B. 乳腺导管内癌
C. 乳腺单纯癌
D. 乳腺硬癌
E. 乳腺髓样癌

正确答案：C。乳腺单纯癌

解析：乳腺单纯癌（C对）的癌组织中实质（肿瘤细胞）与间质（纤维间质）大致相等。乳腺浸润性导管癌（A错）的癌组织中实质与间质比例不同。乳腺导管内癌（B错）无间质浸润。乳腺硬癌（D错）的癌组织中实质少而纤维间质丰富。乳腺髓样癌（E错）的癌组织中实质多而间质较少。